在以R波为主的导联，T波倒置常见的疾病是
A. 心肌梗死
B. 心绞痛发作
C. 绞窄性心包炎
D. 高血压
E. 心律失常

正确答案：B。心绞痛发作

解析：在心绞痛发作（B对）时，大多数患者有一过性ST段（抬高或压低）和T波（低平或倒置改变）。心肌梗死（A错）的特征性心电图表现为ST段呈弓背向上型、病理性Q波和T波倒置（在面向损伤区周围心肌缺血区导联上出现）；绞窄性心包炎（C错）心电图表现为QRS低电压、T波低平或倒置；高血压（D错）一般无特异性心电图表现，当心脏损害出现心室肥厚、冠心病等时，可有相应心电图表现；不同类型的心律失常（E错）可有不同的心电图表现。